唾液的缓冲能力直接关系到口腔内环境的pH值，而pH值的高低决定的龋病的发病率，以下说法正确的是
A. 唾液pH5～7，龋危险性高，缓冲能力低
B. 唾液pH4～5，龋危险性低，缓冲能力中
C. 唾液pH＜4，龋危险性中，缓冲能力高
D. 唾液pH4～5，龋危险性高，缓冲能力中
E. 唾液pH5～7，龋危险性低，缓冲能力高

正确答案：E。唾液pH5～7，龋危险性低，缓冲能力高

解析：唾液的缓冲能力越强，最终pH下降越少。可将缓冲能力分为高、中、低三类，标准是pH5～7、pH4～5和pH＜4，分别代表龋危险性低、中和高。掌握“龋病预测与早期诊断”知识点。